中年男性，上腹部进食后不适数余年，X线钡餐检查见胃窦胃小弯处龛影，大小约2.5cm，龛影口部有一狭颈，黏膜皱壁集中，诊断最可能是
A. 胃溃疡
B. 胃癌
C. 胃炎
D. 十二指肠溃疡
E. 胃憩室

正确答案：A。胃溃疡

解析：该患者中年男性，出现上腹部进食后不适数余年，X线钡餐检查见胃窦胃小弯处龛影，大小约2.5cm，龛影口部有一狭颈，黏膜皱壁集中（胃溃疡的表现），结合患者的表现和辅助检查，诊断最可能是胃溃疡，十二指肠溃疡可见十二指肠球部激惹及球部畸形等（A对D错），胃癌溃疡型（ulcerative type） 部分癌组织坏死脱落，形成溃疡。溃疡一般多呈皿状，有的边缘隆起，如火山口状（B错）。胃憩室：造影可见外部一凸出造影（E错）。